上颌义齿远中游离端基托的颊侧应
A. 覆盖整个上颌结节
B. 覆盖上颌结节的2/3
C. 覆盖上颌结节的1/2
D. 覆盖上颌结节的1/3
E. 让开上颌结节

正确答案：A。覆盖整个上颌结节

解析：上颌后牙游离端义齿基托后缘应伸展到翼上颌切迹，远中颊侧应盖过上颌结节，后缘中部应到硬软腭交界处稍后的软腭上。掌握“局部义齿人工牙及基托”知识点。